肺炎链球菌肺炎合并肺炎胸腔积液的患者，需要考虑胸水引流的情况是
A. 胸水呈血性
B. 胸水LDH升高
C. 胸水有核细胞分类以多核细胞为主
D. 胸水-血清白蛋白梯度增加
E. 胸水细菌培养阳性

正确答案：E。胸水细菌培养阳性

解析：胸水细菌培养阳性，提示脓胸，应及时引流（E对）。胸水呈血性（A错）和LDH升高（B错）提示癌性胸水，反复抽吸使蛋白丢失严重，效果不理想。有核细胞分类以多核细胞为主（C错）提示渗出液，纠正病因后可自行吸收。胸水-血清白蛋白梯度增加提示渗出液（D错）。